女孩，6岁。诊断为单纯型肾病综合征，病程中患儿出现腰痛、尿呈洗肉水样。此时最可能是发生了
A. 泌尿系感染
B. 肾结石
C. 肾衰竭
D. 电解质紊乱
E. 肾静脉血栓形成

正确答案：E。肾静脉血栓形成

解析：患儿，已经诊断为单纯型肾病综合征，在此基础上有了腰痛尿呈洗肉水样的表现，最可能发生了肾静脉血栓形成（E对）。肾结石不属于肾病综合征的并发症（B错），其余四项都属于肾病综合征的并发症：泌尿系感染虽然也有可能有腰痛的表现，但其最大的特征是尿白细胞增加而不是尿红细胞增加（A错）；肾衰竭会有很多系统损伤的表现，而不是仅仅出现腰痛尿呈洗肉水样（C错）。电解质紊乱临床表现可有厌食、乏力、懒言、嗜睡、血压下降甚至出现休克、抽搐等，与该题意不符，不能诊断为电解质紊乱（D错）。